男性，19岁，患病1周。牙龈乳头坏死，前牙唇侧明显，坏死形成溃疡处凹陷，表面灰白色假膜，触之出血明显，口腔有腐败性口臭。体温37.8℃，颏下淋巴结肿痛。既往未出现全身明显异常现象。预计检查后异常表现在
A. 中性粒细胞减少
B. 细胞核分化异常
C. 螺旋体和梭形杆菌数量明显增加
D. 牙槽骨不同程度吸收
E. 龈坏死表现

正确答案：C。螺旋体和梭形杆菌数量明显增加

解析：本题考查坏死性溃疡性龈炎。坏死物涂片检查，可见大量梭形杆菌和螺旋体（C对）。